左心室的出口处有
A. 二尖瓣
B. 主动脉瓣
C. 肺动脉瓣
D. 三尖瓣
E. 下腔静脉瓣

正确答案：B。主动脉瓣

解析：左心室的出口处有主动脉瓣（B对）附着于主动脉口的主动脉瓣环上。